口腔颌面外科多个患者换药时，应遵循的顺序是
A. 先无菌创口，后污染创口，再感染创口
B. 先无菌创口，后感染创口，再污染创口
C. 先污染创口，后感染创口，再无菌创口
D. 先感染创口，后污染创口，再无菌创口
E. 任意一种都可

正确答案：A。先无菌创口，后污染创口，再感染创口

解析：多个患者换药，应遵循先无菌创口，后污染创口，再感染创口的顺序，并每换一人后必须重新洗手，以防交叉感染。掌握“口外创口处理”知识点。